测定某药物的比旋度，若供试品溶液的浓度为10.0mg/ml，样品管长度为2dm，测得的旋光度值为+2.02°，则比旋度为
A. +2.02°
B. +10.1°
C. +20.2°
D. +101°
E. +202°

正确答案：D。+101°